依据内经所述，被称为生之本的脏是
A. 心
B. 肝
C. 脾
D. 肺
E. 肾

正确答案：A。心

解析：本题考查心的功能，同时也是对内经的考查。心为生之本（A对），肝为罢极之本（B错），肺为气之本（D错），肾为封藏之本（E错）。